“十二五”期间，药品电子监管的工作目标要求，在2011年12月31日前纳入药品电子监管的药品有
A. 含麻黄碱类复方制剂
B. 含可待因复方口服溶液
C. 含地芬诺酯复方制剂
D. 第二类精神药品制剂
E. 中药注射剂

正确答案：A、B、C。含麻黄碱类复方制剂；含可待因复方口服溶液；含地芬诺酯复方制剂

解析：本题考查药品监督管理。药品监督管理局于2011年12月31日前将含麻黄碱类复方制剂（A对）、含可待因复方口服溶液（B对）、含地芬诺酯复方制剂（C对）三类药品纳入电子监管。